一般2岁时平均身长约为
A. 75cm
B. 80cm
C. 87cm
D. 90cm
E. 95cm

正确答案：C。87cm

解析：本题考查体格生长常用指标。身高（长）一般1岁时达75cm，2岁时达87cm（C对），2岁后到12岁前（青春期前）平均每年约增加6～7cm，青春期身高加速增长。